属于酸性氨基酸的是
A. 半胱氨酸
B. 苏氨酸
C. 苯丙氨酸
D. 谷氨酸
E. 组氨酸

正确答案：D。谷氨酸

解析：本题考查酸性氨基酸。酸性氨基酸包括谷氨酸（D对）和天冬氨酸。极性中性氨基酸包括丝氨酸、半胱氨酸（A错）、天冬酰胺、谷氨酰胺和苏氨酸（B错）。非极性脂肪族氨基酸包括甘氨酸、丙氨酸、缬氨酸、亮氨酸、异亮氨酸、脯氨酸和甲硫氨酸。碱性氨基酸包括赖氨酸、精氨酸和组氨酸（E错）。芳香族氨基酸包括苯丙氨酸（C错）、酪氨酸和色氨酸。